某甲状腺功能亢进患者，服用抗甲状腺药丙硫氧嘧啶治疗2个月后就诊复查，白细胞急剧下降。白细胞计数3.18×10⁹/L。处置方法除停止使用丙硫氧嘧啶以外，应考虑药物
A. 利血生
B. 螺内酯
C. 核黄素
D. 地高辛
E. 黄体酮

正确答案：A。利血生

解析：本题考查利血生的药理作用。利血生（A对）可用于治疗各种原因引起的白细胞减少、再生障碍性贫血。